病例对照研究利用医院就诊或住院病人作为研究对象时易导致的偏倚种类为
A. 伯克森偏倚
B. 检出偏倚
C. 报告偏倚
D. 测量偏倚

正确答案：A。伯克森偏倚

解析：本题考查伯克森偏倚。病例对照研究利用医院就诊或住院病人作为研究对象时易导致的偏倚种类为伯克森偏倚（A对BCD错）。伯克森偏倚也称入院率偏倚，在以医院为基础的病例对照研究中常发生这种偏倚，即当选择医院病人作为病例和对照时，病例只是该医院或某些医院的特定病例而不是全体病人的随机样本，对照是医院的某一部分病人而不是全体目标人群的一个随机样本，由于医院的医疗条件、病人的居住地区及社会经济文化等多方面因素的影响，病人对医院以及医院对病人都有一定的选择性，特别是因为各种疾病的入院率不同可导致病例组与对照组在某些特征上的系统误差。